一儿童因食用色泽鲜艳的熟肉制品后出现以青紫为主要特征的食物中毒，已诊断为亚硝酸盐食物中毒，较好的救治措施是
A. 给予亚硝酸钠
B. 给予硫代硫酸钠
C. 给予大剂量美蓝
D. 1%美蓝小剂量口服
E. 给予抗生素

正确答案：D。1%美蓝小剂量口服